目赤肿痛属风热证者，可配用
A. 鱼腰、球后
B. 少商、上星
C. 行间、侠溪
D. 血海、膈俞
E. 列缺、照海

正确答案：B。少商、上星

解析：目赤肿痛风热者，加少商、上星（B对）。鱼腰为治疗麦粒肿的主穴（A错）。目赤肿痛肝胆火盛者 加行间、侠溪（C错）。血海、膈腧为治疗神经性皮炎的主穴（D错）。列缺主治：伤风，头痛，项强，咳嗽，气喘，咽喉肿痛，口眼歪斜，牙痛。；照海主治咽喉干燥，痫证，失眠，嗜卧，惊恐不宁，目赤肿痛，月经不调，痛经，赤白带下，阴挺，阴痒，疝气，小便频数，不寐，脚气；列缺配照海治咽喉病症，不用于治疗目赤肿痛（E错）。